急性假膜型口腔念珠菌病的典型临床表现是
A. 舌背黏膜呈鲜红色，并有舌乳头萎缩
B. 义齿承托区黏膜呈亮红色
C. 口角内侧三角区充血伴颗粒增生
D. 口腔黏膜充血，出现凝乳状斑片
E. 口角区黏膜湿白、糜烂、皲裂

正确答案：D。口腔黏膜充血，出现凝乳状斑片

解析：本题考查口腔念珠菌病。急性假膜型口腔念珠菌病的典型临床表现是口腔黏膜充血，出现凝乳状斑片（D对）。急性假膜型念珠菌性口炎的临床表现：多好发部位为颊、舌、软腭及唇，损害区黏膜充血，有散在的色白如雪的柔软小斑点，如帽针头大小；不久即相互融合为白色丝绒状斑片，并可继续扩大蔓延，严重者波及扁桃体、咽部。早期黏膜充血较明显，故呈鲜红色与雪白的对比。而陈旧的病损黏膜充血减退，白色斑片带淡黄色。斑片附着不十分紧密，稍用力可擦掉，暴露红的黏膜糜烂面及轻度出血。